女，24岁。近2个月出现四肢关节疼痛伴皮肤结节、红斑。10天前发热，最高体温38℃，咳嗽，咳少量痰，胸部X线片示右上肺斑片状影伴空洞形成。该患者最可能的诊断是
A. 肺脓肿
B. 肺结核
C. 肺囊肿继发感染
D. 细菌性肺炎
E. 支气管肺癌

正确答案：B。肺结核

解析：患者四肢关节疼痛伴皮肤结节、红斑（风湿热样表现）。10天前发热，最高体温38℃，咳嗽，咳少量痰，胸部X线片示右上肺斑片状影伴空洞形成。符合肺结核、肺外结核表现。最可能诊断是肺结核（B对）。肺脓肿（A错）临床特征为高热、咳嗽和咳大量浓臭痰。肺囊肿继发感染（C错）常有类似肺脓肿症状，易误诊。细菌性肺炎（D错）少见四肢关节受累。支气管肺癌（E错）因患者年龄24岁，一般不首先考虑癌症。